全口义齿试戴时，下列方法可以判断颌位关系是否正确，除了
A. 患者正中咬合时，双侧颞部肌肉收缩明显
B. 患者发“S”音是否有困难
C. 患者张口时，上下颌义齿是否有脱落
D. 患者面容是否自然和谐
E. 患者后牙咬合时，下颌是否偏向一侧

正确答案：C。患者张口时，上下颌义齿是否有脱落

解析：本题考查判断颌位关系是否正确的方法。患者张口时，上下颌义齿是否有脱落（C错，为本题的正确答案）是检查义齿固位力的一个方法不能作为判断颌位关系是否正确的方法。判断颌位关系是否正确，包括垂直距离和正中关系。正中咬合时，双侧颞部肌肉收缩明显（A对）且两侧肌肉的动度一致，则说明下颌已退回到正中关系。发齿音s（B对）、ch时，上下前牙切缘接近，如果位置异常，如下前牙过于偏舌侧，覆盖过大，垂直距离过高或过低（息止牙合间隙过小或过大），或因人工后牙排列过于偏舌侧，舌侧基托过后等，均可会影响发音清晰度；面容自然和谐（D对）也是垂直距离恢复适当的一个表现；后牙咬合是检查正中关系的一个方法（E对），所以都可以作为判断颌位关系是否正确的方法。